横切面淡棕色至暗棕色，木部有4～10个类白色小点排列成环，中央灰黑色的中药材是
A. 知母
B. 续断
C. 胡黄连
D. 射干
E. 川木香

正确答案：C。胡黄连

解析：本题考查的是胡黄连饮片的性状鉴别。横切面淡棕色至暗棕色，木部有4～10个类白色小点排列成环，中央灰黑色的中药材是胡黄连（C对）。胡黄连：【性状鉴别】饮片为不规则的圆形薄片。外表皮灰棕色至暗棕色。切面灰黑色或棕黑色，木部有4～10个类白色点状维管束排列成环。气微，味极苦。知母（A错）：【性状鉴别】饮片呈不规则类圆形的厚片。外表皮黄棕色或棕色，可见少量残存的黄棕色叶基纤维或凹陷或突起的点状根痕。切面黄白色至黄色。气微，味微甜、略苦，嚼之带黏性。续断（B错）：【性状鉴别】饮片续断片呈类圆形或椭圆形的厚片。外表皮灰褐色至黄褐色，有纵皱。切面皮部墨绿色或棕褐色，木部灰黄色或黄褐色，可见放射状排列的导管束纹，形成层部位多有深色环。气微，味苦、微甜而涩。射干（D错）：【性状鉴别】饮片呈不规则形或长条形的薄片。外表皮黄褐色、棕褐色或黑褐色，皱缩，可见残留的须根和须根痕，有的可见环纹。切面淡黄色或鲜黄色，具散在小筋脉点或筋脉纹，有的可见环纹。气微，味苦、微辛。川木香（E错）：【性状鉴别】饮片呈类圆形切片。外皮黄褐色至棕褐色，具纵皱纹及细筋脉纹。切面黄白色至黄棕色，有深棕色稀疏油点及裂隙，木部显菊花心状的放射纹理，有的中心呈枯朽状，形成层环明显。体较轻，质硬脆。气微香，味苦，嚼之粘牙。